体内产生最多的酸是
A. 硫酸
B. 三羧酸
C. 酮体
D. 磷酸
E. 碳酸

正确答案：E。碳酸

解析：体内产生最多的酸是碳酸（E对）。